EB病毒抗体VCA-IgA及EB-DNA检测都可用于鼻咽癌筛查，两种方法的灵敏度分别为70%和65%，若要提高筛查项目的特异度，可采用的联合试验方法是
A. 扩大筛查人群
B. 采用串联试验
C. 采用并联试验
D. 选择筛查高危人群
E. 增加筛查频率

正确答案：B。采用串联试验

解析：本题考查可提高筛查的特异度的联合试验方法。串联试验（B对ACDE错）即一组筛检试验按一定的顺序相连，初筛阳性者进入下一轮筛检，全部筛检试验结果均为阳性者才定为阳性。该方法可以提高特异度，但会使灵敏度降低。